在透明层的表面细菌进入前，酸的扩散导致的脱矿改变的是
A. 透明层
B. 脱矿层
C. 细菌侵入层
D. 坏死崩解层
E. 暗层

正确答案：B。脱矿层

解析：脱矿层位于透明层的表面，是在细菌进入前，酸的扩散所导致的脱矿改变，此层牙本质小管形态仍然比较完整，小管内基本上无细菌侵入。但管周、管间牙本质磷灰石数目减少，说明有脱矿的存在。掌握“牙本质，牙骨质龋”知识点。